同一疾病相隔多长时间复诊者，原则上按初诊处理
A. 1个月
B. 2个月
C. 3个月
D. 4个月
E. 5个月

正确答案：C。3个月

解析：同一疾病相隔3个月以上复诊者，原则上按初诊处理。掌握“口外病史记录”知识点。